深Ⅱ度烧伤局部损伤的深度应达
A. 真皮浅层，部分生发层健在
B. 表皮层，生发层健在
C. 真皮深层，有皮肤附件残留
D. 脂肪层
E. 脂肪下层

正确答案：C。真皮深层，有皮肤附件残留

解析：深Ⅱ°烧伤：伤及皮肤的真皮层，介于浅Ⅱ°和Ⅲ°之间，深浅不尽一致，也可有水疱，但去疱皮后，创面微湿，红白相间，痛觉较迟钝。由于真皮层内有残存的皮肤附件，可赖其上皮增殖形成上皮小岛，如不感染，可融合修复，需时3～4周。但常有瘢痕增生。掌握“火器伤、热烧伤”知识点。